沿腋静脉近端排列的淋巴结是
A. 锁骨上淋巴结
B. 尖淋巴结
C. 外侧淋巴结
D. 胸肌淋巴结
E. 无

正确答案：B。尖淋巴结

解析：外侧淋巴结沿腋静脉远侧段排列（C错），胸肌淋巴结沿胸外侧血管排列（D错），尖淋巴结（B对）沿腋静脉近端排列。